不属于糖皮质激素禁忌证的是
A. 曾患严重精神病
B. 活动性消化性溃疡
C. 角膜炎、虹膜炎
D. 创伤修复期、骨折
E. 严重高血压、糖尿病

正确答案：C。角膜炎、虹膜炎

解析：本题考查糖皮质激素的禁忌证。不属于糖皮质激素禁忌证的是角膜炎、虹膜炎（C错，为本题正确答案）。糖皮质激素的禁忌证：①严重精神病或癫痫病史者（A对）、活动性消化性溃疡病（B对）或新近胃肠吻合术者、骨折患者、创伤修复期患者（D对）、角膜溃疡者、肾上腺皮质功能亢进者、严重高血压、糖尿病患者（E对）。②妊娠早期妇女。③抗菌药物不能控制的水痘、真菌感染者。④未能控制的结核、细菌和病毒感染者。